类风湿性关节炎周围型需做检查是
A. 正斜位片
B. 侧轴位片
C. 正侧双斜位片
D. 正位片
E. 双手正位片包括腕关节

正确答案：E。双手正位片包括腕关节

解析：双手正位片包括腕关节多用于诊断类风湿性关节炎（E对）。拍摄侧位片时仍会遇到重叠信息而妨碍我们观察时，可以拍摄斜位片。检查手、足部位时，我们会常规拍摄正斜位片，所以掌骨跖骨骨折需做的检查是正斜位片（A错）。轴位是相对正位和侧位而言的体位。拍摄轴位片时，X线沿检查部位的长轴方向进行投照。需要轴位检查的部位有髌骨、跟骨等，拍摄轴位片的目的是更容易显示这些部位的骨折、脱位情况（B错）。腰椎峡部裂需做检查是正侧双斜位片（C错）。正位包括前后正位及后前正位，当需要拍摄胸部正位片时，我们用的是胸部后前正位（D错）。